能表现（特异性）细胞毒的细胞是
A. NK细胞
B. B细胞
C. 肥大细胞
D. 细胞毒性T淋巴细胞
E. 浆细胞

正确答案：D。细胞毒性T淋巴细胞